按压形成后的皮肤凹陷在按压结束后很快恢复见于
A. 心源性水肿
B. 肾源性水肿
C. 肝源性水肿
D. 营养不良性水肿
E. 内分泌源性水肿

正确答案：E。内分泌源性水肿

解析：按压形成后的皮肤凹陷在按压结束后很快恢复可见于内分泌疾病甲状腺功能减退症所致的黏液性水肿（E对）。心源性水肿（A错）主要由右心衰竭引起，水肿的特点是首先出现在身体低垂部位，颜面一般不出现水肿，水肿为对称性、凹陷性。肾源性水肿（B错）可见于各型肾炎和肾病，水肿特点是疾病早期晨间起床时有眼睑与颜面水肿，以后很快发展为全身水肿。肝源性水肿（C错）主要由肝硬化引起，主要表现为腹水。营养不良性水肿（D错）可见于低蛋白血症和维生素B1缺乏症，水肿的特点是水肿发生前常有体重减轻表现，常从足部开始逐渐蔓延至全身。